生活饮用水中制定了三氯甲烷和四氯化碳的标准，其原因是
A. 这两种物质可恶化水的感官性状
B. 这两种物质可损害肾脏，引起人群的慢性中毒
C. 二者均具有一定的致癌作用
D. 进行氯化消毒时可产生氯化副产物
E. 以上都不是

正确答案：C。二者均具有一定的致癌作用

解析：本题考查生活饮用水卫生标准的毒理学指标。生活饮用水中制定了三氯甲烷和四氯化碳的标准，其原因是二者均具有一定的致癌作用（C对ABDE错）。标准规定三氯甲烷在饮水中的限值为0.3mg/L，考虑到我国的具体情况，标准规定饮水中三氯甲烷含量不得超过0.06mg/L。标准规定饮水中四氯化碳含量不得超过0.002mg/L。